初期龋的变化不包括
A. 硬组织发生脱矿
B. 微晶结构改变
C. 牙齿透明度下降
D. 牙釉质呈白垩色
E. 牙釉质出现龋洞

正确答案：E。牙釉质出现龋洞

解析：本题考查初期龋的变化。中龋时患牙可出现龋洞（E错，为本题的正确答案）。龋病是一种牙体硬组织慢性进行性破坏的疾病，初期龋釉质表面脱矿（A对），病变区透明度下降（C对），微晶结构改变（B对）、破坏，釉质呈白垩色（D对）。